胶艾汤主治证的病机是
A. 冲任虚损
B. 脾阳不足
C. 血热妄行
D. 肝火犯肺
E. 下焦郁热

正确答案：A。冲任虚损

解析：本题考查胶艾汤主治证的病机。胶艾汤多阿胶、艾叶、甘草、侧重养血止血，兼以调经安胎，是标本兼顾之方，故既可用于冲任虚损，血虚有寒的月经过多，产下血止，又可用治妊娠胎漏下血。胶艾汤功用养血止血，调经安胎，主治妇人冲任虚损，血虚有寒证”（A对）。